面神经核是
A. 味觉核
B. 表情肌运动核
C. 面部感觉核
D. 司泪腺分泌的核
E. 咀嚼肌运动核

正确答案：B。表情肌运动核

解析：面神经核属特殊内脏运动核，支配面肌运动，因而属于表情肌运动核（B对）。味觉核（A错）为孤束核上部。面部感觉核（C错）包括三叉神经脑桥核（接受头面部、口鼻腔的触压觉冲动）、三叉神经脊束核（接受头面部的痛温觉冲动）。司泪腺分泌的核（D错）为上泌涎核。咀嚼肌运动核（E错）为三叉神经运动核。